磺酰脲类药物可用于治疗
A. 糖尿病合并高热
B. 胰岛功能尚存的非胰岛素依赖型糖尿病
C. 糖尿病并发酮症酸中毒
D. 胰岛素依赖型糖尿病
E. 重症糖尿病

正确答案：B。胰岛功能尚存的非胰岛素依赖型糖尿病